关于痛痛病，哪项是错误的
A. 由含镉废水污染农田引起
B. 发病的潜伏期长
C. 患者多为育龄妇女
D. 多在营养不良的条件下发病
E. 多因镉引起的肾衰竭死亡

正确答案：E。多因镉引起的肾衰竭死亡

解析：本题考查痛痛病的相关内容。痛痛病是发生在日本富山县神通川流域部分镉污染地区的一种严重的环境污染性疾病，以全身剧烈疼痛为主要症状而得名，是慢性镉中毒的典型案例。其发病原因主要是由于含镉废水污染农田引起（A对）。该病发病的潜伏期长（B对），且患者多为育龄妇女（C对），多在营养不良的条件下发病（D对）。痛痛病可有低分子蛋白尿、尿糖、尿酶改变等肾脏损伤。但最后患者多因全身极度衰弱和并发其他疾病而死亡，并非死于肾衰竭（E错，为本题正确答案）。